与外源性哮喘关系最密切的抗体是
A. IgA
B. IgD
C. IgG
D. IgE
E. IgM

正确答案：D。IgE

解析：变应性哮喘患者血清特异性IgE（D对）明显升高，大多与IgE调节基因和特异性反应相关的基因遗传有关，当激发因素刺激具有特异性体质的机体后，导致I型变应反应，导致支气管平滑肌收缩、黏液分泌增加、血管通透性增加和炎症细胞浸润，产生相应的临床表现。IgA、（A错）IgD（B错）、IgG（C错）、IgM（E错）等抗原与外源性哮喘关系不密切。